HIV感染者最常见的口腔表现
A. 单纯疱疹
B. 念珠菌病
C. 带状疱疹
D. 毛状白斑
E. 卡波西肉瘤

正确答案：B。念珠菌病

解析：本题考查HIV感染的口腔表现。念珠菌病（B对）是由念珠菌感染引起的口腔黏膜病，常见于免疫缺陷者，HIV感染患者的免疫功能缺陷，常继发口腔念珠菌病，在疾病早期就表现出来，是免疫抑制的早期征象，因此HIV感染最常见的口腔表现是念珠菌病。毛状白斑（D错）被认为是艾滋病患者全身免疫严重抑制的征象之一，出现在疾病晚期，不是HIV感染最常见的口腔表现。卡波西肉瘤（E错）是感染中最常见的口腔恶性肿瘤，但不是最常见的口腔表现，是艾滋病的临床诊断指征之一。单纯疱疹（A错）是由单纯疱疹病毒引起的病毒感染性疾病，为HIV感染者常见的疱疹病毒损害，不如念珠菌病常见。带状疱疹（C错）是由水痘－带状疱疹病毒引起的疾病。